肾脏不产生的激素是
A. 肾素
B. 促红细胞生成素
C. 激肽
D. 前列腺素
E. 血管升压素

正确答案：E。血管升压素

解析：血管升压素（E对）由下丘脑视上核和室旁核的大细胞神经元合成。肾脏也属于内分泌器官，可分泌肾素（A错）、促红细胞生成素（B错）、激肽（C错）、前列腺素（D错）。